妊娠患者最不宜选用的降压药为
A. 利尿剂
B. α受体阻滞剂
C. β受体阻滞剂
D. 二氢吡啶类钙拮抗剂
E. 血管紧张素转换酶抑制剂

正确答案：E。血管紧张素转换酶抑制剂

解析：血管紧张素转换酶抑制剂（E错，为本题正确答案）可引起胎儿畸形、胎儿发育不良甚至死胎，所以妊娠期患者不宜选用。利尿剂（A对）、α受体阻滞剂（B对）、β受体阻滞剂（C对）、二氢吡啶类钙拮抗剂（D对）都可以用于妊娠期高血压的治疗。